男，65岁，低热伴右侧腹痛不适半年。查体：贫血貌，右侧中腹部扪及6cm×4cm质硬肿块，可推动，压痛不明显。最可能的诊断是
A. 肠结核
B. 盲肠套叠
C. 右肾肿瘤
D. 升结肠癌
E. 阑尾周围脓肿

正确答案：D。升结肠癌

解析：患者老年男性，出现低热、右侧腹痛及肿块、贫血（右侧结肠癌典型症状），最可能的诊断是升结肠癌（D对）。肠结核（A错）好发于年轻人，全身中毒症状明显，肿块固定有压痛，患者无结核中毒症状，肿块可推动且压痛不明显，可排除肠结核。患者年老，无突发性剧烈腹痛和血便，排除肠套叠（B错）。无血尿、无腰痛，排除右肾肿瘤（C错）。阑尾周围脓肿（E错）右下腹固定点压痛明显，患者无此表现，应排除阑尾周围脓肿。